主要用于治疗室性心律失常，对室上性心律失常基本无效的药物是
A. 腺苷
B. 普萘洛尔
C. 胺碘酮
D. 维拉帕米
E. 利多卡因

正确答案：E。利多卡因

解析：本题考查利多卡因。利多卡因（E对）为钠离子通道阻滞剂，是治疗室性心律失常的首选药，对室上性心律失常基本无效；腺苷（A错）临床用于迅速终止折返性室上性心律失常；普萘洛尔（B错）临床主要用于室上性快速心律失常、室性心律失常；胺碘酮（C错）临床治疗心房扑动、心房纤颤和室上性心动过速；维拉帕米（D错）临床治疗室上性心律失常。